易导致下肢静脉曲张的作业是
A. 井下
B. 计算机操作
C. 重体力
D. 缝纫
E. 长期站立或行走

正确答案：E。长期站立或行走